属于卵巢上皮性肿瘤的是
A. 畸胎瘤
B. 卵黄囊瘤
C. 浆液性肿瘤
D. 纤维瘤
E. 颗粒细胞瘤

正确答案：C。浆液性肿瘤

解析：卵巢肿瘤主要组织学类型为上皮性肿瘤、生殖细胞肿瘤、性索－间质肿瘤及转移性肿瘤。浆液性（C对）肿瘤属于卵巢上皮性肿瘤。畸胎瘤（A错）、卵黄囊瘤（B错）属于生殖细胞肿瘤。颗粒细胞瘤（E错）、纤维瘤（D错）属于性索－间质肿瘤。